属于缺陷病毒的是
A. HAV
B. HBV
C. HCV
D. HDV
E. HEV

正确答案：D。HDV

解析：丁型肝炎病毒（HDV）在体内腐质必须有HBV或其他噬肝DNA病毒辅助获得包膜，才能腐质增殖，故称为缺陷性病毒。掌握“丙型、丁型、戊型肝炎病毒”知识点。